以下哪项属于医疗风险管理的内容
A. 以患者为中心
B. 加强人文关怀
C. 严格遵守医疗卫生法律、法规
D. 完善医疗风险的识别、评估和防控措施
E. 对其医务人员进行医疗卫生法律、法规的培训

正确答案：D。完善医疗风险的识别、评估和防控措施

解析：医疗风险管理主要是指：①加强医疗风险管理，完善医疗风险的识别、评估和防控措施，定期检查措施落实情况，及时消除隐患；②开展手术、特殊检查、特殊治疗等具有较高医疗风险的诊疗活动，医疗机构应当提前预备应对方案，主动防范突发风险。其余均为遵守医疗卫生法律和恪守职业道德的内容。